男，16岁，发热4天伴纳差2天急诊。检查：血压114/70mmHg，左脚拇趾甲沟部红肿破溃，血白细胞计数为20×10⁹/L，中性粒细胞为89%。经血培养证实金黄色葡萄球菌阳性，根据经验首选抗生素是
A. 丁胺卡那霉素
B. 环丙沙星
C. 红霉素
D. 万古霉素
E. 甲硝唑

正确答案：D。万古霉素

解析：患者有发热的症状，经血培养证实金黄色葡萄球菌阳性，故可以诊断该患者为金黄色葡萄球菌肺炎。金黄色葡萄球菌的耐药率高，对于耐药的金黄色葡萄球菌，可选用万古霉素、替考拉宁和利奈唑胺等（D对）。丁胺卡那霉素（A错）是氨基糖苷类抗生素，主要用于革兰阴性杆菌的感染，治疗葡萄球菌肺炎需联合耐青霉素霉的半合成青霉素或头孢菌素。环丙沙星（B错）为第三代喹诺酮类抗菌药物，可用于金黄色葡萄球菌的治疗，但不是首选。红霉素（C错）主要治疗肺炎支原体、衣原体以及军团菌的感染。甲硝唑（E错）对厌氧菌有很好的抗菌作用，对金黄色葡萄球菌无效。